关于孕妇膳食原则的叙述不正确的是
A. 提高优质蛋白质摄入量
B. 增加含钙、铁、锌丰富的食品摄入
C. 增加含叶酸维生素B₂丰富的食品摄入
D. 选用碘盐
E. 提高脂肪占总能量供给的比例

正确答案：E。提高脂肪占总能量供给的比例

解析：本题考查孕妇膳食原则。孕妇膳食中应有适量脂肪，包括饱和脂肪酸、n-3和n-6系列多不饱和脂肪酸以保证胎儿和自身的需要。但孕妇血脂较平时升高，脂肪摄入总量不宜过多（E错，为本题正确答案）。孕妇膳食应提高优质蛋白质摄入量（A对），增加含钙、铁、锌丰富（B对）以及含叶酸维生素B₂丰富的食品摄入（C对）。孕妇膳食还应选用碘盐（D对），因为孕妇碘缺乏可能导致胎儿甲状腺功能低下，从而引起以生长发育迟缓，认知能力降低为特征的呆小症。